不能作为糖异生原料的是
A. 乳酸
B. 生糖氨基酸
C. 乙酰CoA
D. α-酮戊二酸
E. 甘油

正确答案：C。乙酰CoA